静脉注射某药，X₀=60mg，若初始血药浓度为15㎍/ml，其表观分布容积V是
A. 0.25L
B. 2.5L
C. 4L
D. 15L
E. 40L

正确答案：C。4L

解析：本题考查单室模型静脉注射给药。根据表观分布容积公式：V=X₀/C₀，式中X₀为静注剂量，C₀为初始浓度。可知，V=60mg/15㎍/mL=4L（C对）。